关于卡托普利治疗高血压的特点，下列说法错误的是
A. 用于各型高血压，不伴有反射性心率加快
B. 防止和逆转血管壁增厚和心肌肥厚
C. 降低糖尿病、肾病等患者肾小球损伤的可能性
D. 降低血钾
E. 久用不易引起脂质代谢障碍

正确答案：D。降低血钾